症见胸中烦热，口苦咽干，腹痛喜暖，大便稀溏。临床诊断最可能的是
A. 表实里虚证
B. 表实里虚证
C. 真热假寒证
D. 真寒假热证
E. 上热下寒证

正确答案：E。上热下寒证

解析：患者同时存在胸中烦热、口苦咽干等上焦热证及腹痛喜暖、大便稀薄等中焦脾胃虚寒证的表现，称为上热下寒证（E对）。患者素体气血虚弱，复感风寒之邪，出现恶寒发热、无汗、头身疼痛、神疲乏力、少气懒言、心悸失眠、舌淡脉弱等，为表实里虚证（A错）。患者素体阳气不足，复感风热之邪，出现发热恶寒、有汗、头痛咽痛、尿清便溏、腹部胀满等，为表热里寒（B错）。真热假寒证（C错）是指疾病的本质为热证，却出现某些“寒象”的表现，又称“热极似寒”。真寒假热证（D错）是指疾病的本质为寒证，却出现某些“热象”的表现，又称“寒极似热”。